构成脊髓丘系的神经元胞体位于
A. 脊神经后根节内
B. 脊髓后角内
C. 脊髓侧角内
D. 薄束核、楔束核内
E. 三叉神经脊束核内

正确答案：B。脊髓后角内

解析：脊髓丘系是传导躯干和四肢痛温觉、粗略触觉和压觉的神经纤维之一，传导通路的第1级神经元为脊神经节内假单极神经元，位于脊神经后根节内（A错），传导痛温觉的纤维（细纤维）在后根的外侧部入脊髓后角内（B对），再终止于第2级神经元；传导粗略触觉和压觉的纤维（粗纤维）经后根内侧部进入脊髓后角内，再终止于第2级神经元。第二级神经元发出纤维上升 1-2 个节段经白质前连合交叉到对侧的外侧索和前索内上行，组成脊髓丘脑侧束和脊髓丘脑前束（侧束传导痛温觉，前束传导粗略触觉和压觉），第3级神经元的胞体在背侧丘脑的腹后外侧核。